有机溶剂中，哪一类多具有肝脏毒性
A. 醛类
B. 芳香烃类
C. 醇类
D. 氯代烃类

正确答案：D。氯代烃类

解析：本题考查具有肝脏毒性的毒物。有机溶剂按其化学结构特征可分为芳香烃类、脂肪烃类、脂环烃类、卤代烃类等。同类者毒性相似，例如氯代烃（D对ABC错）类多具有肝脏毒性，氯代饱和烷烃的肝脏毒性随氯原子取代的数量而增大。